慢性汞中毒的特征性临床表现是
A. 口腔炎、发热、皮疹
B. 神经精神症状、震颤、口腔炎、肾脏表现
C. 周围神经炎，腹痛、贫血
D. 口腔炎、腹痛、肾功能障碍
E. 贫血、易兴奋、皮疹

正确答案：B。神经精神症状、震颤、口腔炎、肾脏表现